男，68岁。阵发性胸闷3年，持续加重6小时后突发意识丧失。查体：BP40/20mmHg，双肺呼吸音清，心率32次/分，律齐，各瓣膜区未闻及杂音。血清肌钙蛋白水平增高。入院后经抢救患者病情平稳，但第3天突发喘憋，不能平卧。查体：心尖部可闻及3/6级收缩期杂音，双肺满布湿啰音。该患者最可能合并
A. 心脏乳头肌断裂
B. 急性心包炎
C. 二尖瓣狭窄
D. 主动脉瓣狭窄
E. 肺部感染

正确答案：A。心脏乳头肌断裂

解析：患者老年男性，阵发性胸闷病史，持续加重6小时，血清肌钙蛋白（急性心肌梗死特异性标记物）水平增高，考虑诊断为急性心肌梗死。查体：心律整齐，但心率仅32次/分，可能为急性心肌梗死伴三度房室传导阻滞。急性心肌梗死最常见的并发症为乳头肌功能失调或断裂，其可导致二尖瓣脱垂并关闭不全而出现吹风样收缩期杂音，若乳头肌整体断裂，可出现明显心力衰竭症状如急性肺水肿。本例患者入院第三天出现心衰症状（喘憋、不能平卧、双肺满布湿啰音），且有心尖部收缩期杂音，均符合心脏乳头肌断裂的表现，因此患者最可能合并心脏乳头肌断裂（A对）。急性心包炎（P302）（B错）多有与呼吸运动相关的心前区疼痛，常可于胸骨左缘第3、4肋间闻及心包摩擦音。二尖瓣狭窄（P287）（C错）特征性杂音为心尖区舒张中晚期低调的隆隆样杂音，主动脉瓣狭窄（P296）（D错）多可在胸骨右缘1～2肋间闻及粗糙而响亮的射流性杂音，两者杂音性质均与本例不符。肺部感染（E错）多有咳嗽、咳痰和发热等症状，心脏杂音很少见。